百分条图表示各组成部分的百分构成比，其作用同于
A. 条图
B. 线图
C. 圆图
D. 直方图
E. 散点图

正确答案：C。圆图